对医疗废物收集、运送、贮存、处置活动中的环境污染防治工作实施统一监督管理的是
A. 市容监督管理部门
B. 城市规划行政主管部门
C. 卫生行政主管部门
D. 检验检疫行政主管部门
E. 环境保护行政主管部门

正确答案：E。环境保护行政主管部门